起自主动脉弓的是
A. 椎动脉
B. 颈内动脉
C. 左锁骨下动脉
D. 右锁骨下动脉
E. 上颌动脉

正确答案：C。左锁骨下动脉

解析：左锁骨下动脉（C对）、头臂干、颈总动脉均起自主动脉弓。